《中华人民共和国刑法》规定，生产、销售假药，对人体健康造成特别严重危害的，处以
A. 拘役，并处罚金
B. 三年以上十年以下有期徒刑，并处罚金
C. 死刑，并处罚金
D. 管制
E. 无期徒刑

正确答案：C。死刑，并处罚金

解析：本题考查生产、销售、提供假药的刑事责任。《中华人民共和国刑法》规定，生产、销售假药，对人体健康造成特别严重危害的，处以死刑，并处罚金（C对）。生产、销售、提供假药的刑事责任认定及刑罚：根据《刑法》第一百四十一条规定，生产、销售假药的，处三年以下有期徒刑或者拘役，并处罚金（A错）；对人体健康造成严重危害或者有其他严重情节的，处三年以上十年以下有期徒刑，并处罚金（B错）；致人死亡或者有其他特别严重情节的，处十年以上有期徒刑、无期徒刑或者死刑，并处罚金或者没收财产（E错）。